石膏含量测定的成分是
A. 含水硫酸钠
B. 含水硫酸钙
C. 二硫化二砷
D. 硫化汞
E. 二硫化铁

正确答案：B。含水硫酸钙